男，45岁休克病人，中心静脉压4cmH₂0，血压60/40mmHg，该病人可能
A. 血容量严重不足
B. 肾功能不全
C. 心功能不全
D. 肺功能不全
E. 容量血管过度舒张

正确答案：A。血容量严重不足

解析：该患者为休克病人，中心静脉压低（正常值为5-10㎝H₂O，当其＜5㎝H₂O时表示血容量不足），血压低（血压低于90/60mmHg即为低血压，有休克危险），提示该病人可能血容量严重不足（A对）。详见表5-2 中心静脉压与补液的关系。肾功能不全表现为少尿（B错）。心功能不全表现为CVP正常或增高，而血压降低（C错）。肺功能不全表现为动脉血氧分压降低（D错）。容量血管过度舒张表现为中心静脉压下降，而血压正常（E错）。